城乡规划卫生的目的是
A. 预防疾病
B. 增进人民身心健康
C. 延长寿命
D. 提高生活质量
E. 以上都是

正确答案：E。以上都是

解析：本题考查城乡规划卫生的目的。城乡规划卫生是在城乡规划中贯彻可持续发展战略和以人为本的指导思想，利用各种自然环境信息、人口信息、社会文化经济信息，以维持和恢复生态系统为宗旨，以人类与自然环境的和谐共处为目标，建立优良的人居环境，以获得人类生存所需的最佳环境质量。城乡规划卫生要考虑到与自然的生态平衡、人居环境的改善和提高、社会生态的合理和生存环境的相互适应，促使城乡生态环境向着良性循环发展，创造既满足居民生理、心理、社会、人文等多层次的需求，又安全、便捷、舒适、健康的人居环境，达到预防疾病、促进健康、延长寿命、提高生活质量的目的（E对ABCD错）。